穿棘孔的动脉是
A. 椎动脉
B. 穿动脉
C. 颈内动脉
D. 脑膜中动脉
E. 基底动脉

正确答案：D。脑膜中动脉

解析：脑膜中动脉穿棘孔进入颅腔（D对）。椎动脉穿 1 -6 颈椎横突孔（A错）。颈内动脉经颈动脉管入颅后行于颈内动脉沟内（C错）。基底动脉不穿棘孔（E错）。